当仿制药处方辅料不影响药物吸收时，可以豁免人体生物等效性试验的剂型是
A. 普通片剂或胶囊剂
B. 口服混悬剂
C. 延迟释放制剂
D. 口服溶液剂
E. 缓释制剂

正确答案：D。口服溶液剂

解析：本题考查常见剂型的生物等效性研究。如果不含可能显著影响药物吸收或生物利用度的辅料，口服溶液剂（D对）可豁免人体生物等效性试验。